两种或两种以上组分混合时，不影响混合效果的是
A. 比例
B. 密度
C. 带电性
D. 颜色
E. 吸湿性

正确答案：D。颜色

解析：本题考查影响混合的因素。两种或两种以上组分混合时，不影响混合效果的是颜色（D错，为本题正确答案）。影响混合的因素：（1）各组分的比例量（A对）；（2）各组分的密度（B对）；（3）含低共熔组分；（4）混合时间；（5）各组分的黏附性与带电性（C对）；（6）其他：含液体成分或吸湿性（E对）组分。